下列哪个不需终末消毒
A. 流感
B. 甲肝
C. 菌痢
D. 霍乱、副霍乱
E. 乙肝

正确答案：A。流感

解析：本题考查终末消毒。终末消毒是当传染源痊愈、死亡或离开后对疫源地进行的彻底消毒，从而清除传染源所播散在外界环境中的病原体。对外界抵抗力较强的病原体引起的传染病才需要进行终末消毒，如鼠疫、霍乱（D对）、病毒性肝炎（BE对）、菌痢（C对）、结核、伤寒、炭疽、白喉等，而流感（A错，为本题正确答案）、水痘、麻疹等疾病一般不需要进行终末消毒。